洋地黄毒苷溶解性的特点是
A. 易溶于水
B. 易溶于石油醚
C. 易溶于氯仿
D. 易溶于乙醚
E. 易溶于环己烷

正确答案：A。易溶于水